某医师治疗心神烦乱、失眠多梦、心悸不宁时，每选朱砂安神丸，此因该中成药除能镇惊安神外，还能
A. 逐痰降火
B. 益气强心
C. 滋阴养血
D. 清心养血
E. 疏肝解郁

正确答案：D。清心养血

解析：本题考查的是朱砂安神丸的功能。朱砂安神丸除能镇惊安神外，还能清心养血（D对）。朱砂安神丸：【功能】清心养血，镇惊安神。礞石滚痰丸：【功能】逐痰降火（A错）。麝香保心丸：【功能】芳香温通，益气强心（B错）。天王补心丸：【功能】滋阴养血（C错），补心安神。解郁安神颗粒：【功能】疏肝解郁（E错），安神定志。